用于治疗寻常痤疮的药物是
A. 炉甘石洗剂
B. 莫匹罗星软膏
C. 克罗米通乳膏
D. 联苯苄唑乳膏
E. 过氧苯甲酰凝胶

正确答案：E。过氧苯甲酰凝胶

解析：本题考查痤疮的治疗药物。治疗痤疮药分为局部用治痤疮药和全身用治痤疮药。局部用治痤疮药：①局部用维A类：维A酸、阿达帕林；②过氧化物：过氧苯甲酰（E对）；③抗感染药：克林霉素、红霉素、林可霉素。全身用治痤疮药：①维生素A类：异维A酸；②其他全身用药：米诺环素、甲硝唑、升华硫。炉甘石洗剂（A错）为润肤及皮肤保护药。莫匹罗星软膏（B错）为皮质激素类皮肤制剂。克罗米通乳膏（C错）为皮肤寄生虫与感染治疗药。联苯苄唑乳膏（D错）为皮肤真菌感染治疗药。